下列指标中属于肾功能受损评价指标的有
A. 肾素（Renin）
B. 尿胆红素（BIL）
C. 血清尿素氮（BUN）
D. 血肌酐（Cr）
E. 肌酐清除率（Ccr）

正确答案：C、D、E。血清尿素氮（BUN）；血肌酐（Cr）；肌酐清除率（Ccr）

解析：本题考查肾功能检查。属于肾功能受损评价指标的有血清尿素氮（C对）、血肌酐（D对）、肌酐清除率（E对）。肾功能的评价方法除了验尿了解其24小时尿中白蛋白外，还可以验血测定血中尿素的含量，一般用血尿素氮（BUN）表示。个体化给药方案制订方法介绍的血清肌酐法中，血清肌酐（SCR）和肌酐清除率（Ccr）也是评价肾功能的指标。肾素（A错）归于肾素-血管紧张素-醛固酮系统，是协助调节体内的长期血压与细胞外液量的。尿胆红素（B错）是尿常规检查中的项目。